由单纯需氧菌引起的颌面部感染约为
A. 0.05
B. 0.15
C. 0.35
D. 0.6
E. 0.9

正确答案：A。0.05

解析：由单纯需氧菌引起的颌面部感染约为5%。掌握“口腔颌面部感染概论”知识点。